传统农业的劳动卫生问题是
A. 高温中暑
B. 急、慢性骨关节损伤
C. 有害气体
D. 眼外伤、牲畜暴力伤等
E. 以上都是

正确答案：E。以上都是